性格的特征不包括
A. 对现实的态度
B. 意志特征
C. 情绪特征
D. 应激特征
E. 智力特征

正确答案：D。应激特征

解析：性格最主要的特征是意识倾向性，表现在对现实的态度方面，如对人有善良、怜悯、傲慢等；对工作和学习的态度方面，如有责任心、有条不紊或漫不经心；对自己的态度方面,如有自信、谦虚或自以为是等。在对行为的调节控制方面，表现为性格的意志特征，如有人始终如一、坚定不移；也有人半途而废、见异思迁。在对情绪的控制方面，表现为性格的情绪特征，如开朗、郁闷。在认知活动的特点与风格方面，表现为性格的理智特征，如有人善于思考、创新，人则因循守旧。掌握“人格”知识点。